不得进行广告宣传的药品有
A. 麻醉药品
B. 非麻醉性戒毒药品
C. 试生产的药品
D. 第二类精神药品
E. 中药饮片

正确答案：A、C、D。麻醉药品；试生产的药品；第二类精神药品

解析：本题考查不得发布广告的药品。按照规定，不得做广告的产品包括：①麻醉药品（A对）、精神药品（D对）、医疗用毒性药品、放射性药品、药品类易制毒化学品，以及戒毒治疗的药品、医疗器械；②军队特需药品、军队医疗机构配制的制剂；③医疗机构配制的制剂；④依法停止或者禁止生产、销售或者使用的药品、医疗器械、保健食品和特殊医学用途配方食品；⑤法律、行政法规禁止发布广告的情形；⑥批准试生产的药品（C对）。